香豆素类化合物基本骨架的碳数是
A. C9-C4
B. C3-C3
C. C6-C3-C6
D. C6-C3
E. C6-C6

正确答案：D。C6-C3